Down综合征的发病率特点描述正确的是
A. 母亲年龄越小发病率越高
B. 母亲年龄越大发病率越高
C. 父亲年龄越小发病率越高
D. 父亲年龄越大发病率越高
E. 父母年龄差距越大发病率越高

正确答案：B。母亲年龄越大发病率越高

解析：Down综合征的发病率与母亲的年龄有关。据调查母亲年龄越大发病率越高，究其原因可能是由于卵细胞在母体内减数分裂过程较长，卵子老化，且受环境因素的影响，易产生染色体的不分离。掌握“反应全身疾病的牙周炎”知识点。